阴阳互损引起的病理变化是
A. 阳偏胜
B. 阴偏胜
C. 阳偏衰
D. 阴偏衰
E. 阴阳两虚

正确答案：E。阴阳两虚

解析：阴阳互损指在阴或阳任何一方虚损的前提下，病变发展到相对的另一方，形成阴阳两虚的病机变化（E对）。阴阳偏胜指人体阴阳双方中的某一方过于亢盛，导致邪气盛为主的病机变化，分别有阳偏盛和阴偏盛（AB错）。阴阳偏衰指人体阴阳二气中某一方虚衰不足的病机变化，属于“精气夺则虚”的虚性病机，分别有阳偏衰和阴偏衰（CD错）。